胃脘痛取内关、足三里，其配穴方法是
A. 前后配穴
B. 表里配穴
C. 左右配穴
D. 上下配穴
E. 本经配穴

正确答案：D。上下配穴

解析：上下配穴法是指将腰部以上或上肢腧穴和腰部以下或下肢腧穴配合应用的方法。内关定位在上肢属手厥阴心包经，足三里定位在下肢属足阳明胃经，相互配合使用为上下配穴（D对）。前后配大法（A错）是指将人体前部和后部的腧穴配合应用的方法；表里经配穴法（B错）是以脏腑、经脉的阴阳表里配合关系为依据的配穴方法；左右配穴法（C错）是指将人体左侧和右侧的的穴配合应用的方法；本经配穴法（E错）是当某一脏腑、经脉发生病变时，即选该脏腑、经脉的腧穴配成处方的配穴方法。